涎腺多形性低度恶性腺癌的病理特征是
A. 细胞学上的一致性和组织学上的多形性
B. 细胞学上的多形性和组织学上的一致性
C. 细胞学上的异形性和组织学上的多形性
D. 细胞学上的一致性和组织学上的单一性
E. 以上都不是

正确答案：A。细胞学上的一致性和组织学上的多形性

解析：光镜观察：多形性低度恶性腺癌的特征是细胞形态的一致性、组织结构的多样性及浸润性生长方式。该疾病明显的特征是不同病例或同一病例内组织结构的多形性。其中包括：小叶状结构、乳头或乳头囊状结构、筛状结构、条索状结构和小导管样结构。肿瘤边缘部细胞常呈单列形成“溪流”状。局部区域可见大嗜酸性粒细胞、透明细胞、鳞状细胞或黏液细胞。肿瘤细胞向邻近组织呈浸润性生长，可侵犯颌骨。掌握“多形性低度恶性腺癌”知识点。